麻疹并发肺炎隔离至出疹后
A. 15天
B. 10天
C. 5天
D. 21天
E. 8天

正确答案：B。10天

解析：麻疹患者应隔离至出疹后5天，若并发肺炎，则隔离至出疹后10天（B对）。